患者男，50岁，颈部弥漫性肿大，边缘不清，与情绪有关，皮色如常，肿块随吞咽动作上下移动，伴急躁易怒，善太息。此病首选治疗方剂为
A. 逍遥散
B. 海藻玉壶汤
C. 四海舒郁丸
D. 桃红四物汤
E. 生脉散

正确答案：C。四海舒郁丸

解析：根据“颈前正中肿大，发胀”，辨为“瘿病”；根据“质软不硬，常太息，胸闷，两胁窜痛，苔薄白，脉弦”，辨为“瘿病”之“气郁痰阻证”；其机理是气机郁滞，痰浊壅阻，凝结颈前，治疗时应以理气舒郁、化痰软坚、消瘿散结为主，方用四海舒郁丸加减（C对）。逍遥散有疏肝健脾养血的作用，用于肝郁脾虚血弱证（A错）。海藻玉壶汤治疗瘿病以理气活血、化痰消瘿为主，用于痰结血瘀证（B错）。桃红四物汤，有活血化瘀的作用，可合五苓散，治疗瘀水互结之水肿病（D错）。生脉散功用为益气生津，敛阴止汗，主治温热、暑热，耗气伤阴证（E错）。